上颌牙列自侧切牙起就开始向后弯曲，弓形牙列的前牙段向前突出比较明显，牙列的形态为
A. 尖圆形
B. 方圆形
C. 椭圆形
D. 混合型
E. 圆弧形

正确答案：A。尖圆形

解析：尖圆形：上颌牙列自侧切牙起就开始向后弯曲，弓形牙列的前牙段向前突出比较明显。掌握“牙列”知识点。